根据《中华人民共和国药品管理法实施条例》的规定，药品生产企业使用的直接接触药品的包装材料，必须
A. 符合医药行业标准
B. 符合药用标准
C. 符合保障人体健康、安全标准
D. 经省级药品监督管理部门批准注册
E. 经国务院药品监督管理部门批准注册

正确答案：B、C、E。符合药用标准；符合保障人体健康、安全标准；经国务院药品监督管理部门批准注册

解析：本题考查药品生产质量管理。根据《中华人民共和国药品管理法实施条例》的规定，药品生产企业使用的直接接触药品的包装材料，必须符合药用要求（B对）和保障人体健康、安全的标准（C对），并经国务院药品监督管理部门批准注册（E对）。